女，35岁。头晕3年，夜尿增多1年。查体：BP180/110mmHg，无特殊体貌。实验室检查：血钾2.8mmo/L，血肾素活性和血管紧张素降低，醛固酮水平增高。CT示右肾上腺1.0cm椭圆形低密度占位。拟行手术治疗，术前控制血压的最佳药物是
A. 螺内酯
B. α受体拮抗剂
C. 氨苯蝶啶
D. 氢氯噻嗪
E. β受体拮抗剂

正确答案：A。螺内酯

解析：患者头晕，夜尿增多，血压高，低血钾，血肾素活性和血管紧张素降低，醛固酮水平增高。CT示右肾上腺1.0cm椭圆形低密度占位。诊断首先考虑醛固酮瘤。拟行手术治疗，术前控制血压的最佳药物是螺内酯（A对）。醛固酮瘤的根治方法为手术切除。术前宜用低盐饮食、螺内酯作准备，以纠正低血钾，并降低高血压。每日螺内酯120-240mg，分次口服，待血钾正常，血压下降后，减至维持量时即进行手术。